女，32岁。发热伴寒战3天，肉眼血尿1天，无尿频、尿痛。查体：右肾区叩痛（+）。尿常规：蛋白（+），RBC30～40/HP。WBC20～30/HP，管型3～5/LP。其管型最可能是
A. 透明管型
B. 蜡样管型
C. 白细胞管型
D. 颗粒管型
E. 上皮细胞管型

正确答案：C。白细胞管型

解析：患者青年女性（急性肾盂肾炎的好发人群），发热、寒战（全身感染中毒症状）伴肉眼血尿，无尿频、尿痛（排除急性膀胱炎），右肾区叩痛，尿常规：蛋白（+），RBC30～40/HP，WBC20～30/HP（提示尿路感染存在），管型3～5/LP。根据患者年龄、性别、临床表现、体查及实验室检查，考虑患者为急性肾盂肾炎，其为化脓性炎症疾病，因此其管型最可能是白细胞管型（C对）。透明管型（A错）在肾病综合症、慢性肾炎、恶性高血压和心力衰竭时可见增多。蜡样管型（B错）提示有严重的肾小管变性坏死，预后不良。颗粒管型（D错）意味着在蛋白尿的同时有肾小管上皮细胞的退变、坏死，多见于各种肾小球疾病及肾小管的毒性损伤。上皮细胞管型（E错）是由肾小管内层剥落的上皮细胞包涵或粘附于透明管型所形成的，巨细胞病毒和肝炎病毒亦可造成上皮细胞死亡。